第二乳磨牙早失，第一恒磨牙尚未萌出或萌出不足时采用
A. 远中导板保持器
B. 丝圈保持器
C. 功能性活动保持器
D. 舌弓保持器
E. 间隙扩展装置

正确答案：A。远中导板保持器

解析：本题考查间隙保持器的种类及适应证。远中导板式间隙保持器适用于第二乳磨牙早失、第一恒磨牙尚未萌出或萌出不足（A对）。带环丝圈式保持器用于第一恒磨牙萌出后，第二乳磨牙单侧早期丧失的病例（B错）。功能性活动保持器又叫可摘式间隙保持器，用于乳磨牙缺失两个以上者，或两侧乳磨牙缺失，或伴有前牙缺失（C错）。舌弓式间隙保持器适用于第二乳磨牙或第一恒磨牙存在的病例（D错）。间隙恢复装置用于推第一恒磨牙向远中移动（E错）。